急性肾小球肾炎的主要临床表现是
A. 少尿，水肿，蛋白尿，低蛋白血症
B. 血尿，蛋白尿，水肿，低蛋白血症
C. 水肿，蛋白尿，血尿，高血压
D. 血尿，少尿，水肿，蛋白尿
E. 水肿，少尿，蛋白尿，高血压

正确答案：C。水肿，蛋白尿，血尿，高血压

解析：急性肾小球肾炎简称急性肾炎，是以急性肾炎综合征为主要临床表现一组疾病，特点为急性起病，患者出现血尿、蛋白尿、水肿和高血压（C对），并可伴有一过性肾功能不全。ABDE为干扰选项，不是任何疾病的主要临床表现。